患儿5岁，形体偏瘦，不思饮食，食而不化，神倦多汗，大便偏稀，夹有不消化食物，舌质淡，苔薄白，脉弱。应选用的方剂是
A. 异功散加减
B. 养胃增液汤加减
C. 不换金正气散加减
D. 保和丸加减
E. 枳术丸加减

正确答案：A。异功散加减

解析：本题考查的是厌食的辨证论治。患儿5岁，形体偏瘦，不思饮食，食而不化，神倦多汗，大便偏稀，夹有不消化食物，舌质淡，苔薄白，脉弱。应选用的方剂是异功散加减（A对）。厌食，是指脾胃受纳运化功能失常所致的疾病，以较长时间的厌恶进食，食量减少为临床特征。西医学的厌食症可参考此内容辨证论治。（一）脾失健运证：【症状】食欲不振，厌恶进食，食而乏味，或伴胸脘痞闷，嗳气泛恶，偶尔多食则脘腹饱胀，大便不调，形体尚可，精神如常。舌淡红，苔薄白或薄腻，脉尚有力。【方剂应用】基础方剂为不换金正气散（陈皮、苍术、厚朴、草果、半夏、甘草、藿香、生姜、大枣）加减（C错）。（二）脾胃气虚证：【症状】不思进食，食不知味，神倦多汗，大便溏薄夹不消化食物，面色少华，形体偏瘦，肢倦乏力。舌淡，苔薄白，脉缓无力。【方剂应用】基础方剂为异功散（人参、白术、茯苓、陈皮、甘草）加减。（三）脾胃阴虚证：【症状】不思进食，食少饮多，皮肤失润，大便偏干，小便短黄，甚或烦躁少寐，手足心热。舌红少津，苔少或花剥，脉细数。【方剂应用】基础方剂为养胃增液汤（石斛、乌梅、沙参、玉竹、白芍、甘草）加减（B错）。保和丸加减（D错）是积滞乳食内积证的方剂应用。积滞乳食内积证：【症状】不思乳食，嗳腐酸馊，或呕吐食物、乳片，脘腹胀满疼痛，大便酸臭或便秘，烦躁啼哭，夜眠不安，手足心热。舌质红，苔白厚，或黄厚腻，脉弦滑，或指纹紫滞。【方剂应用】基础方剂为乳积用消乳丸（香附、神曲、麦芽、陈皮、砂仁、甘草）加减；食积用保和丸（山楂、神曲、半夏、茯苓、陈皮、连翘、莱菔子）加减。方剂应用为枳术丸（E错）的病证，2022年考试指南未明确说明。